肾乳头
A. 肾锥体之间的肾皮质
B. 肾皮质之间的肾髓质
C. 伸入肾大盏内
D. 由2-3个肾锥体尖端合成
E. 顶端仅有1个乳头孔

正确答案：D。由2-3个肾锥体尖端合成

解析：肾乳头由2-3个肾锥体尖端合成（D对），伸入肾小盏内（C错），顶端有许多小孔（E错）。肾锥体之间的肾皮质称肾柱（A错）。